男，68岁，吸烟、饮酒40多年。有高血压病史。某年冬天晨起时发现左下肢不能动，入院后诊断为脑卒中。以下医生的建议不合理的是
A. 不良生活方式是疾病原因之一，应戒烟限酒
B. 控制血压，预防再发
C. 告知患者定期来医院检查身体
D. 告知患者康复注意事项
E. 告知患者天气太冷是引发该病的直接因素

正确答案：E。告知患者天气太冷是引发该病的直接因素

解析：患者老年男性，吸烟、饮酒40多年（脑卒中常见诱因）。有高血压病史（脑卒中高危因素）。某年冬天晨起时发现左下肢不能动（脑卒中患者发生偏身障碍），入院后诊断为脑卒中。关于脑卒中不良生活方式是疾病原因之一，应戒烟限酒（A对）；控制血压，预防再发（B对）；告知患者定期来医院检查身体（C对）；告知患者康复注意事项（D对），均为正确建议。脑卒中的病因主要由血管病变及栓塞引起，与环境原因无具体明显关系，天气太冷可为疾病诱因，但并非引发该病的直接因素（E错，为本题正确答案）。